要控制社会经济地位对结果的影响，适宜的对照是
A. 邻居对照
B. 配偶对照
C. 同胞对照
D. 人群对照
E. 医院对照

正确答案：A。邻居对照

解析：本题考查对照的选择。邻居对照（A对BCDE错）能够控制社会经济地位对研究结果的影响。